通过查房、会诊和病例讨论获取信息，属于
A. 手工积累信息
B. 软件存储信息
C. 药物生产信息
D. 网上下载信息
E. 临床用药信息

正确答案：E。临床用药信息

解析：本题考查的是药学信息的相关内容。通过查房、会诊和病例讨论获取信息，属于临床用药信息（E对）。通过查房、会诊和病例讨论获取临床用药信息。去图书馆查找近期专业期刊并制作卡片属于手上积累信息（A错）；《中毒急救资讯系统》是湖南医科大学附属二院开发的软件，属软件存储信息（B错）；通过互联网从药学网站上及时获取信息，属网上下载信息（D错）。